男，30岁，有夜磨牙症史及紧咬牙史多年，最有可能出现的临床体征是
A. 牙齿松动
B. 牙齿过度磨耗
C. 肌肉抽搐
D. 失眠
E. 张口受限

正确答案：B。牙齿过度磨耗

解析：本题考查夜磨牙的临床体征。男，30岁，有夜磨牙症史及紧咬牙史多年，最有可能出现的临床体征是牙齿过度磨耗（B对）。夜磨牙往往用力大、速度快，且无食物的缓冲及唾液的润滑，会导致牙齿过度磨耗。引起牙松动的原因有牙槽骨吸收、（牙合）创伤、牙周膜的急性炎性、根尖周炎症等（A错）。牙齿过度磨耗，使颌间垂直距离过短，导致咀嚼肌松弛，一般不会出现肌肉抽搐（C错）。失眠一般与精神、环境因素有关（D错）。牙齿过度磨耗可导致颌间垂直距离过短，从而引起颞下颌关节病损（E错）。